治疗阿米巴痢疾的药物是
A. 左旋咪唑
B. 阿苯达唑
C. 伊维菌素
D. 替硝唑
E. 乙胺嗪

正确答案：D。替硝唑

解析：本题考查替硝唑的适应症。治疗急性阿米巴痢疾的药物是替硝唑（D对）。